成人食管全长约为
A. 10cm
B. 15cm
C. 25cm
D. 35cm
E. 45cm

正确答案：C。25cm

解析：成人食管长约25cm(C对)。